医师发现或怀疑胎儿异常的，应当对孕妇进行产前诊断。"产前诊断"是指
A. 健康诊查
B. 胎儿发育诊察
C. 胎儿先天性缺陷诊断
D. 对孕妇进行遗传病诊察
E. 对孕妇进行传染病诊察

正确答案：C。胎儿先天性缺陷诊断